tRNA约占总RNA的
A. 0.05
B. 0.1
C. 0.15
D. 0.2
E. 0.25

正确答案：C。0.15

解析：本题考查RNA。tRNA约占总RNA的15%（C对）。